胎膜早破的病因不包括
A. 钙缺乏
B. 维生素C缺乏
C. 病原微生物上行感染
D. 胎膜受力不均
E. 羊膜腔压力增高

正确答案：A。钙缺乏

解析：胎膜早破的病因包括：①生殖道感染：病原微生物上行性感染（C对）；②羊膜腔压力增高（E对）；③胎膜受力不均（D对）；④营养因素：缺乏维生素C（B对）、锌及铜（A错，为本题正确答案）。